老年女性重度子宫脱垂，无生育要求者，应釆取的治疗方法是
A. 子宫托疗法
B. 阴式子宫全切术
C. 高锰酸钾溶液坐浴
D. 阴道切除术合子宫托疗法
E. 子宫全切术

正确答案：B。阴式子宫全切术

解析：老年重度脱垂女性因其年龄较大无生育要求且无特殊手术禁忌，则最佳选择的术式是阴式子宫切除术（B对）。子宫托是使子宫和阴道壁维持在阴道内而不脱出的工具，子宫托疗法（A错）是适用于各度子宫脱垂和阴道前后壁脱垂，但重度子宫脱垂伴盆地肌明显萎缩以及宫颈或阴道壁有炎症和溃疡者均不宜使用，经期和妊娠期停用。高锰酸钾溶液（C错）适用于细菌性阴道炎患者治疗，不适用于老年性子宫重度脱垂患者。阴道切除术合子宫托法（D错）是适用于年老体弱不能耐受较大手术又不需要保留性交功能者，不适用本患者于重度子宫脱垂患者。子宫全切手术（E错）适用于较年轻、宫颈较长且希望保留性交功能者，对老年重度脱垂女性非最佳选择。